在分配稀有卫生资源时，不应该坚持的是
A. 个人的实际需要
B. 个人之间的平均分配
C. 个人的支付能力
D. 个人的实际工作能力
E. 个人对社会的贡献

正确答案：B。个人之间的平均分配

解析：在分配稀有卫生资源时，我们要遵循公正的原则。公正原则是指以形式公正与内容公正的有机统一为依据分配和实现医疗和健康利益的伦理原则，即具有同样医疗需要以及同等社会贡献和条件的人应得到同样的医疗待遇。反之，不同的病人则分别享受有差别的医疗待遇。因此，在分配稀有卫生资源时，不应该坚持个人之间的平均分配（B错，为本题正确答案），而应根据个人的实际需要（A对）、个人的支付能力（C对）、个人的实际工作能力（D对）和个人对社会的贡献（E对）。